义齿初戴时要检查以下内容，除了
A. 基牙有无松动、龋坏
B. 卡环与（牙合）支托就位、密合
C. 基托与黏膜密合，边缘伸展适度，无翘动、压痛
D. 连接杆与黏膜接触的紧密程度是否恰当
E. 咬合接触是否均匀

正确答案：A。基牙有无松动、龋坏

解析：本题考查局部义齿的初戴。义齿初戴时要检查以下内容，除了基牙有无松动、龋坏（A错，为本题正确答案）。基牙有无松动、龋坏是在初诊是应该检查的。义齿初戴的检查及处理：①卡环和（牙合）支托应做到（牙合）支托与（牙合）支托凹密合，卡环与牙面密合（B对），卡环臂尖在倒凹区，卡环体在非倒凹区，（牙合）支托、卡环体不影响咬合。若卡环在基牙上的位置不合适，可用技工钳加以调整；（牙合）支托如有移位，可从塑料内取出加以调整，用自凝塑料固定，（牙合）支托略高时，可磨改早接触点，但不能磨改过多，以免造成折断，必要时可磨改对颌牙。②基托与黏膜组织密贴，边缘伸展适度，平稳无翘动、无压痛（C对）。如基托与黏膜组织不密贴，要寻找是否有影响基托就位的障碍点。边缘过长、组织面于下颌隆突区缓冲不够，咬合有早接触点使力集中在某一点，均可导致咬合时疼痛，都应分别找出原因，并做适当修改。③连接杆与黏膜接触的紧密程度是否恰当（D对）：连接杆与黏膜接触的紧密程度如两者之间有较大的间隙，可能造成食物嵌塞，唾液滞留引起不适；如接触过紧，则压迫黏膜产生压痛。④咬合接触是否均匀（E对）：咬合关系先检查正中（牙合）后检查非正中（牙合），如有早接触点，应调磨到人工牙和天然牙都有均匀接触；如个别牙无（牙合）接触或咬合低，可用自凝。